天然水被人兽粪便等含氮有机物污染后，经微生物分解形成的最初产物是
A. 有机氮
B. 蛋白氮
C. 氨氮
D. 亚硝酸盐氮
E. 硝酸盐氮

正确答案：C。氨氮

解析：本题考查含氮化合物。含氮化合物包括有机氮、蛋白氮、氨氮、亚硝酸盐氮和硝酸盐氮。天然水被人兽粪便等含氮有机物污染后，经微生物分解形成的最初产物是氨氮（C对ABDE错）。